心动周期中左心室容积最大的时期是
A. 快速射血期末
B. 快速充盈期末
C. 减慢充盈期末
D. 减慢射血期末
E. 心房收缩期末

正确答案：E。心房收缩期末